改善急性左心衰竭症状最有效的药物是
A. 血管紧张素转换酶抑制剂
B. 钙通道阻滞剂
C. 强心药
D. 小剂量多巴胺
E. 利尿剂

正确答案：E。利尿剂

解析：利尿药（E对）可促进Na⁺和水的排除，从而减轻心脏负荷，有利于减轻急性左心衰患者的肺水肿，首选利尿药是噻嗪类药物，必要时可选用强效髓袢利尿药呋塞米等。血管紧张素转换酶抑制剂（A错）（P232）起效较慢，主要作用是可以防止和逆转心室的重构，提高心脏及血管的顺应性，最主要的是用于慢性心力衰竭。钙通道阻滞剂（B错）（P241）主要作用是扩张外周动脉，减轻心脏后负荷，但是并不能减少血容量，不能缓解急性左心衰引起的肺水肿症状。强心药（C错）、小剂量多巴胺（D错）都可以用于急性心衰的治疗，但是并不能减少血容量，不能缓解急性左心衰引起的肺水肿症状。